不同纬度地区流感的季节性流行有着不同的特征，下列说法正确的是
A. 流感大流行期间，高峰期可发生改变
B. 在温带地区，流感大多呈现明显的秋冬季流行高峰
C. 在温带地区，流感流行的季节性不是特别明显
D. 在温带地区，一年内通常会在秋冬季和夏季出现两次流行高峰
E. 在热带或亚热带地区，流感大多呈现明显的冬春季流行高峰

正确答案：A。流感大流行期间，高峰期可发生改变

解析：本题考查不同纬度地区流感的季节性流行特征。在温带地区，流感大多呈现明显的冬春季流行高峰（BCD错）；而在热带或亚热带地区，流感流行的季节性并不明显，全年均有流感病毒的循环，一年内通常会在秋冬季和夏季出现两次流行高峰（E错）。流感大流行期间，高峰期可发生改变（A对）。